传导躯干、四肢意识性本体觉的神经纤维最终投射到
A. 丘脑
B. 小脑
C. 外侧膝状体
D. 基底核
E. 中央后回上2/3和中央旁小叶后部

正确答案：E。中央后回上2/3和中央旁小叶后部

解析：传导躯干、四肢意识性本体觉的第3级神经纤维最终投射到中央后回上2/3和中央旁小叶后部（E对）。